下列哪个选项不是暴露的特征
A. 暴露途径
B. 暴露速率
C. 暴露期限
D. 暴露频率

正确答案：B。暴露速率

解析：本题考查暴露的特征。暴露特征是决定外源化学物对机体损害作用的另一个重要因素，包括暴露途径（A对）和暴露期限（C对）及暴露频率（D对）等。暴露速率（B错，为本题正确答案）不是暴露的特征。